按照我国“人类辅助生殖技术伦理原则”的要求，目前允许实施的辅助生殖技术是
A. 人卵胞浆移植
B. 精子捐赠助孕
C. 胚胎赠送助孕
D. 人卵核移植
E. 非商业性代孕

正确答案：B。精子捐赠助孕

解析：按照我国“人类辅助生殖技术伦理原则”的要求，目前允许实施的辅助生殖技术是精子捐赠助孕（B对）。根据保护后代原则…⑤医务人员不得实施代孕技术（E错）。⑥医务人员不得实施胚胎赠送助孕技术（C错）。⑦在尚未解决人卵胞浆移植和人卵核移植技术安全性问题之前，医务人员不得实施以治疗不育为目的的人卵胞浆移植（A错）和人卵核移植技术（D错）。